患者，男，62岁，因高血压长期服用硝苯地平，血压控制良好。近期因出现午后低热、盗汗就诊，痰培养检出结核分枝杆菌，诊断为肺结核，给予利福平、异烟肼、乙胺丁醇、吡嗪酰胺抗结核治疗。用药4周后，患者血压升高到185/90mmHg。最可能的原因是
A. 异烟肼可诱导CYP3A4，导致硝苯地平血药浓度降低
B. 乙胺丁醇可抑制CYP3A4，导致硝苯地平血药浓度升高
C. 吡嗪酰胺可抑制CYP3A4，导致硝苯地平血药浓度升高
D. 利福平可诱导CYP3A4，导致硝苯地平血药浓度降低
E. 肺结核疾病本身所致的血压升高，与用药无关

正确答案：D。利福平可诱导CYP3A4，导致硝苯地平血药浓度降低

解析：本题考查抗结核病药的相互作用。利福平为肝药酶CYP3A4诱导剂，联合用药时可加速硝苯地平的代谢，药物t1/2缩短，血药浓度降低，疗效减弱（D对）。